新生儿，临床诊断为双侧完全性唇、腭裂。腭裂修复术的最佳时间是
A. 出生后6～12个月
B. 出生后2岁左右
C. 出生后30个月
D. 出生后3～5岁
E. 出生后5～6岁

正确答案：B。出生后2岁左右

解析：本题考查腭裂修复术的最佳时间。对于腭裂整复术的手术年龄目前仍存在争议，考虑到为了培养患儿正确的发音习惯，目前多数医生以及市面上大量资料都认同出生后12个月-24个月左右（B对）实施手术为宜。6～12个月（A错）患儿此时还不能发音，可待年龄稍大些再进行手术，而且此时进行手术也较困难，麻醉风险也较高。若出生后30个月（C错）实施手术，已经错过患儿最初发音年龄，不利于养成正确的发音习惯。出生后3～5岁（D错）和出生后5～6岁（E错），由于患儿年龄较大，此时实施腭裂整复手术，其效果远远不如早期。